上述各项，涉及“公正”伦理问题的是
A. 有限的移植器官供体如何分配给需要者
B. 有些器官移植是在亲属间进行的
C. 用确认脑死亡患者的器官施行器官移植术
D. 器官移植者的人格完整有待改善
E. 器官移植的前景未达到全球的合作

正确答案：A。有限的移植器官供体如何分配给需要者

解析：器官移植的公正原则是指在可供移植器官少而需求多的情况下，器官分配要保证公正、透明，应努力尽可能使最合适和最迫切需要移植器官的病人得到移植，避免仅考虑有无支付能力和社会地位高低，即有限的移植器官供体如何分配给需要者（A对）。